女，28岁，患缺铁性贫血。膳食中应注意选择含铁丰富且吸收率高的食物尤其是
A. 猪肝、瘦肉
B. 牛奶、鸡蛋
C. 大豆及豆制品
D. 鱼虾
E. 蔬菜、水果

正确答案：A。猪肝、瘦肉